正确描述子宫的是
A. 为腹膜内位器官
B. 前屈为子宫体与阴道之间形成的夹角
C. 前倾为子宫体与颈之间形成的夹角
D. 子宫圆韧带是维持子宫前倾位的主要结构
E. 子宫主韧带位于子宫的两侧

正确答案：D。子宫圆韧带是维持子宫前倾位的主要结构

解析：子宫为腹膜间位器官（A错），前屈是子宫体于子宫颈的夹角（B错），前倾是子宫体与阴道的夹角（C错），子宫圆韧带是维持子宫前倾位的主要结构（D对），子宫主韧带位于子宫颈的两侧（E错）。